诊断早期原发性肝癌最有意义的检查是
A. CEA
B. CA199
C. CA125
D. AFP
E. PSA

正确答案：D。AFP

解析：AFP（甲胎蛋白）（D对）为诊断早期原发性肝癌最有意义的检查，在排除妊娠和生殖腺胚胎瘤的基础上，AFP＞400ng/ml为诊断肝癌的条件之一。CEA（九版诊断学P417）（A错）即癌胚抗原，是一种广谱性肿瘤标志物，可在多种肿瘤中表达，脏器特异性低，在临床上主要用于结直肠癌的复发监测。CA19-9（九版诊断学P419）（B错）即糖链抗原199，在胰腺癌、肝胆和胃肠道疾病时可明显升高，目前临床上主要作为胰腺癌的首选肿瘤标志物。CA125（九版诊断学P420）（C错）即癌抗原125，对诊断卵巢癌有较大临床价值，尤其对观察治疗效果和判断复发较为灵敏。PSA（九版诊断学P417）（E错）是前列腺特异抗原，为前列腺癌的特异性标志物。